喉腔借前庭襞、声襞分成喉前庭、喉中间腔和声门下腔3部分。关于声门裂的叙述，下列哪项是正确的
A. 是喉腔最狭窄的部位
B. 是两侧声襞之间的裂隙
C. 声韧带游离缘之间称膜间部
D. 杓状软骨之间称软骨间部
E. 是声带之间的窄隙

正确答案：A。是喉腔最狭窄的部位

解析：声门裂是喉腔最狭窄之处（A对）。声门裂是两侧声襞与构状软骨底和声带突之间的裂隙（BE错）。声门裂前2/3位于两侧声带之间称膜间部（C错），后1/3位于两侧杓状软骨底和声带突之间称软骨间部（D错）。